某药品监督管理部门接到多名眼疾患者举报，反应在县医院眼科就诊使用某药后发生“眼内炎”。药品监管部门经过调查，确认该药为假药，其法定依据为
A. 未标明有效期
B. 未标明生产批号
C. 未经批准进口
D. 超过有效期
E. 擅自添加着色剂

正确答案：C。未经批准进口

解析：该县医院眼科就诊使用的药品经过药品监管部门调查确认该药为假药。依照《药品管理法》规定，未经批准进口（C对）的药品按假药论处，属于假药。劣药，是指药品成分含量不符合国家药品标准规定的药品。《药品管理法》规定，未标明有效期（A错）、未标明生产批号（B错）、超过有效期（D错）和擅自添加着色剂（E错）的药品属于劣药的范畴。